属于甲胶类胶剂的是
A. 阿胶
B. 新阿胶
C. 鹿角胶
D. 龟甲胶
E. 阿拉伯胶

正确答案：D。龟甲胶

解析：本题考查的是胶剂的分类。属于甲胶类胶剂的是龟甲胶（D对）。胶剂的分类：按原料来源，胶剂分为以下几类。（1）皮胶类：以动物皮为原料，如以驴皮、猪皮为原料制成的阿胶（A错）与新阿胶（B错），以牛皮为原料制成的黄明胶。（2）骨胶类：以动物骨骼等为原料，如狗骨胶、鹿骨胶等。（3）甲胶类：以动物甲壳等为原料，如龟甲胶、鳖甲胶。（4）角胶类：以动物骨化的角为原料，如鹿角胶（C错）。（5）其他胶类：以含有蛋白质的动物类中药为原料，如以牛肉为原料制成的称霞天胶，以龟甲和鹿角为原料制成的混合胶剂称龟鹿二仙胶。阿拉伯胶（E错），2022年考试指南未明确说明。